热交换可用公式S＝M±C±R－E表示，当机体产热多于散热量时
A. S＝0
B. S＞0
C. S≥0
D. S＜0
E. S≤0

正确答案：B。S＞0

解析：本题考查热交换。热交换可用公式S＝M±C±R－E表示，式中S为人体蓄热状况；M为代谢产热量；C为传导、对流吸收或放散的热量；R为辐射散热或吸收的热量；E为蒸发散热量。当机体产热和散热量相等时，S＝0；产热多于散热时，S＞0（B对ACDE错），造成热蓄积，体温上升；当散热多于产热时，S＜0，导致体温下降。